患者上颌中切牙近中面龋，冷测不敏感，叩（-），探诊深龋洞，腐质较干燥，呈粉末状，则该牙治疗方法可选择
A. 根管治疗
B. 拔除患牙
C. 光固化树脂充填
D. 玻璃离子水门汀充填
E. 氢氧化钙垫底，光固化树脂充填

正确答案：E。氢氧化钙垫底，光固化树脂充填

解析：前牙修复要考虑美观需要，光固化树脂充填效果较好，深龋洞应氢氧化钙护髓再行树脂充填。掌握“深龋的治疗”知识点。